患儿，5个月。多汗夜惊，烦躁易哭，方颅，前囟2cm×2cm，形体虚胖。其治疗首选方剂是
A. 玉屏风散
B. 人参五味子汤
C. 牡蛎散
D. 四君子汤
E. 八珍汤

正确答案：B。人参五味子汤

解析：患儿多汗夜惊，烦躁易哭，方颅，前囟2cm×2cm，形体虚胖。脾土虚弱则肺金不生，肺气不足，卫外不固，故多汗、易感。故治疗首选方剂是人参五味子汤加减（B对）。反复呼吸道感染肺脾气虚，方药：玉屏风散加减（A错）。牡蛎散主治体虚自汗、盗汗证（C错）。四君子汤用于脾胃虚弱证（D错）。八珍汤用于治疗干疳（E错）。